细辛属于
A. 蓼科
B. 木兰科
C. 芸香科
D. 茄科
E. 马兜铃科

正确答案：E。马兜铃科

解析：本题考查的是细辛的来源。细辛属于马兜铃科（E对）。细辛：【来源】为马兜铃科植物北细辛、汉城细辛或华细辛的干燥根和根茎。来源于蓼科（A错）的中药有大黄、虎杖、何首乌、蓼大青叶等。来源于木兰科（B错）的中药有厚朴、辛夷、五味子、南五味子等。来源于芸香科（C错）的中药有黄柏、关黄柏、白鲜皮、枳壳、吴茱萸等。来源于茄科（D错）的中药有地骨皮、洋金花、枸杞子、天仙子等。